治疗急性肾小球肾炎风寒束肺，风水相搏证，应首选
A. 麻黄汤合五苓散
B. 麻黄汤合五皮饮
C. 麻黄连翘赤小豆汤
D. 越婢加术汤
E. 五皮饮合五苓散

正确答案：A。麻黄汤合五苓散

解析：急性肾小球肾炎风寒束肺，风水相搏证，治宜疏风散寒，宣肺行水，首选发汗解表，宣肺平喘的麻黄汤合利水渗湿，温阳化气五苓散（A对）。五皮饮利水消肿，理气健脾，主治水停气滞之皮水证（B错）。麻黄连翘赤豆小汤主治湿热蕴郁于内，外阻经络肌肤之病候，配合五味消毒饮可治疗急性肾小球肾炎疮毒内归，湿热蕴结证（C错）。越婢加术汤散风清热，宣肺行水为治疗急性肾小球肾炎风热犯肺，水邪内停证的代表方（D错）。五皮饮利水消肿，理气健脾，主治水停气滞之皮水证；五苓散利水渗湿，温阳化气（E错）。